服用后可致嗜睡，驾驶员应慎用的药物是
A. 氯苯那敏
B. 吲达帕胺
C. 胰酶
D. 阿司匹林
E. 阿托品

正确答案：A。氯苯那敏

解析：本题考查驾驶员用药。氯苯那敏（A对）服用后可引起嗜睡和反应能力降低而影响驾驶员安全。吲达帕胺（B错）服用后出现多尿、多汗或尿频。胰酶（C错）可用于胰腺分泌功能不足或消化酶不足者。阿司匹林（D错）禁用于妊娠及哺乳期妇女。阿托品（E错）使睫状肌调节麻痹，导致驾驶员视近物不清或模糊，约持续1周。